牙胶尖的成分不包括
A. 牙胶
B. 碘仿
C. 氧化锌
D. 蜡和松香
E. 重金属磷酸盐

正确答案：B。碘仿

解析：本题考查牙胶尖的成分。牙胶尖的成分不包括碘仿（B错，为本题正确答案）。牙胶尖是目前临床上常用的根管充填材料，牙胶尖受热时会软化，易溶于氯仿、乙醚和丙酮，微溶于桉油醇，牙胶尖毒性较小，很少有致敏作用，超出根尖孔时有较好的组织耐受性，使用前可将牙胶尖置于2.5%～5%NaClO或75%的乙醇溶液浸泡消毒一分钟。牙胶（A对）、氧化锌（C对）、蜡和松香（D对）、重金属磷酸盐（E对）均为牙胶的成分，牙胶中不含有碘仿。